不属于临产后正常宫缩特点的是
A. 节律性
B. 规律性
C. 对称性
D. 极性
E. 缩复作用

正确答案：B。规律性

解析：临产后正常宫缩特点：（1）节律性（A对）；（2）对称性（C对）；（3）极性（D对）；（4）缩复作用（E对），因此规律性（B错，为本题正确答案）不属于临产后正常宫缩特点。